急性细菌性痢疾病变最显著地部位是
A. 回肠末端
B. 直肠和乙状结肠
C. 升结肠
D. 降结肠
E. 整个结肠

正确答案：B。直肠和乙状结肠

解析：菌痢的典型临床表现为腹泻与里急后重，里急后重即直肠刺激症状，而直肠刺激症状多发生在直肠，由此可以推出菌痢病变最显著的部位应该是乙状结肠和直肠（B对），菌痢若累及其他部位如回肠末端（A错）、升结肠（C错）、降结肠（D错）、整个结肠（E错）一般不会出现直肠刺激症状。